关于片剂润滑剂作用的说法，错误的是
A. 降低压片颗粒间的摩擦力，增加流动性
B. 避免粉粒在冲、模表面粘附，使片面光洁
C. 避免压片颗粒间互相黏附，使片剂易于崩解
D. 利于准确加料，减少片重差异
E. 降低片剂与冲、模间的摩擦力，利于出片

正确答案：C。避免压片颗粒间互相黏附，使片剂易于崩解

解析：本题考查的是片剂辅料润滑剂的作用。关于片剂润滑剂作用的说法，错误的是避免压片颗粒间互相黏附，使片剂易于崩解（C错，为本题正确答案）。片剂的润滑剂：压片前必须加入的，能增加颗粒（或粉末）流动性，减少颗粒（或粉末）与冲模内摩擦力，具有润滑作用的物料称为润滑剂。润滑剂的作用主要有：①降低压片颗粒（或粉粒）间的摩擦力，增加颗粒（或粉粒）的流动性（A对），利于准确加料，减少片重差异（D对）。②避免粉粒在冲模表面黏附，确保片面光洁（B对）。③降低粉粒或片剂与冲模间的摩擦力，利于正常压片和出片，同时减少冲模磨损。